女，35岁，因左下后牙对冷热刺激敏感1周前来就诊。检查发现左下第一磨牙（牙合）面深龋洞，探诊洞底感酸痛，冷测反应一过性敏感，叩痛（-）。牙龈无异常。该患牙的诊断是可复性牙髓炎，作鉴别诊断时，最有价值的检查方法是
A. X检查
B. 温度测试
C. 探诊
D. 咬诊
E. 视诊

正确答案：B。温度测试

解析：本题考查鉴别可复性牙髓炎和深龋以及不可复性牙髓炎。可复性牙髓炎的明显特点是对冷测反应一过性敏感，深龋往往是当冷、热刺激进入深龋洞内才出现疼痛反应，不会在冷测时出现一过性敏感，不可复性牙髓炎温度刺激引起的反应程度较重，持续时间较长久，这三种疾病对温度测试的反应明显不同，因此，在作鉴别诊断时，温度测试（B对）最有价值。X线检查（A错）能看到大致的龋损范围，但是当龋坏近髓时，从X线片上并不能区分出深龋和可复性牙髓炎。探诊（C错）深龋和可复性牙髓炎患牙的龋洞时，都会有酸痛不适感，故探诊的鉴别诊断价值不大。咬诊（D错）主要用于判断牙隐裂，深龋和可复性牙髓炎都没有叩痛咬合痛，故咬诊无鉴别诊断意义。视诊（E错）时，深龋和可复性牙髓炎都可见深龋洞，不见穿髓孔，看到的情况相似，故视诊无明显诊断意义。